下列不属于症状监测的内容的是
A. 发热、腹泻
B. 呼吸道症状
C. 不良饮食习惯
D. 学校或单位的缺勤率
E. 药店非处方药（如VitC、感冒药等）的销售情况

正确答案：C。不良饮食习惯

解析：本题考查症状监测的内容。常用的症状监测主要有流感症状（咳嗽、喷嚏等）监测、发热监测、腹泻病监测等。症状监测不依赖特定的诊断，是强调非特异症状为基础的监测，所监测的内容，不仅有临床症状（如发热、腹泻（A对）、呼吸道症状（B对）等），还包括许多与疾病相关的现象，主要有：①医院急诊室或门诊病人就医情况；②药店非处方药（如维生素C、感冒药、止泻药等）的销售情况（E对）；③医疗相关用品（如医用口罩、卫生纸巾等）的销售量；④学校或单位的缺勤率（D对）；⑤动物患病或死亡情况；⑥生物媒介变化情况等。不良饮食习惯（C错，为本题正确答案）属于行为及行为危险因素监测的内容。